寒邪的性质是
A. 升散
B. 趋下
C. 重浊
D. 开泄
E. 收引

正确答案：E。收引

解析：本题考查的是六淫的性质。寒邪的性质是收引（E对）。病因，即指引起人体疾病的原因，又称致病因素、病邪。在中医病因学中六淫是最主要的发病因素之一。六淫即风、寒、暑、湿、燥、火六种外感病邪的统称。六淫的性质及致病特点：1.风邪的性质及致病特点。（1）风为阳邪，其性开泄（D错），易袭阳位；（2）风邪善行而数变；（3）风为百病之长。2.寒邪的性质及致病特点：（1）寒为阴邪，易伤阳气；（2）寒性凝滞，主痛；（3）寒性收引。3.暑邪的性质及致病特点：（1）暑为阳邪，其性炎热；（2）暑性升散（A错），耗气伤津；（3）暑多挟湿。4.湿邪的性质及致病特点：（1）湿为阴邪，易阻遏气机，损伤阳气；（2）湿性重浊（C错）；（3）湿性黏滞；（4）湿性趋下（B错），易伤阴位。5.燥邪的性质及致病特点：（1）燥性干涩，易伤津液；（2）燥易伤肺。6.火邪的性质及致病特点：（1）火热为阳邪，其性炎上；（2）火易伤津耗气；（3）火热易生风动血；（4）火热易发肿疡。